地高辛的表观分布容积为500L，远大于人体体液的容积，原因可能是
A. 药物全部分布在血液
B. 药物全部与组织蛋白结合
C. 大部分与血浆蛋白结合，与组织蛋白结合少
D. 大部分与血浆蛋白结合，药物主要分布在组织
E. 药物在组织和血浆分布

正确答案：D。大部分与血浆蛋白结合，药物主要分布在组织

解析：本题考查表观分布容积。表观分布容积是体内药量与血药浓度相互关系的一个比例常数，用V=X/C表示。由V=X/C可知，X=CV，X为总药量，当X一定时，药物大部分与组织蛋白结合，主要分布在组织（D对）中，血液中药物的浓度减少，表观分布容积增大。